下颌运动的形式包括
A. 开闭口运动
B. 前伸后退运动
C. 侧方运动
D. B+C
E. A+B+C

正确答案：E。A+B+C

解析：下颌运动的形式下颌运动是一个三维运动，通常将该运动简化为开闭口运动、前伸后退运动和侧方运动三种基本形式来分析和描述。掌握“下颌运动的形式、范围及意义”知识点。